小儿舌体肿大，板硬麻木，舌色深红，其病机是
A. 心火上炎
B. 心脾积热
C. 脾胃积热
D. 热入营血
E. 阴伤内热

正确答案：B。心脾积热

解析：心脾积热，舌为心之苗，火热循经上行，故舌体肿大，板硬麻木，舌色深红（B对）。心火上炎见舌上溃疡（A错）。脾胃积热可见舌苔黄腻（C错）。热入营血可见舌质绛红，舌有红刺（D错）。阴伤内热可见舌红少苔，甚至无苔而干者（E错）。